动作电位沿神经纤维到达神经肌接头时，使终板膜产生终板电位，然后在什么部位引发动作电位
A. 肌细胞膜
B. 接头后膜
C. 横管膜
D. 三联管膜
E. 终板膜

正确答案：A。肌细胞膜